病史采集包括
A. 主诉
B. 患者系统疾病史
C. 患者传染性疾病史
D. 患者的修复治疗情况
E. 以上都对

正确答案：E。以上都对

解析：病史采集的内容包括：①主诉；②现病史；③既往史：全身系统病史（与口腔修复治疗计划相关的全身系统疾病、影响口腔支持组织固位能力的疾病或身体状态、了解患者传染性疾病史、心理卫生状况以及精神疾病史）和口腔专科病史（修复治疗史、牙体牙髓治疗史、牙周病史、正畸治疗史、口腔外科治疗史、放射影像资料、颞下颌关节病史）；④相关疾病的家族病史。掌握“修复学病史采集”知识点。